阿托品的临床应用
A. 眼压降低
B. 促进腺体分泌
C. 解除平滑肌痉挛
D. 心脏骤停
E. 过敏性休克

正确答案：C。解除平滑肌痉挛

解析：本题考查阿托品的临床应用。阿托品的临床应用是解除平滑肌痉挛（C对）。阿托品的临床应用：1.抑制腺体分泌（B错）：阿托品能阻断腺体细胞膜上M胆碱受体，使腺体分泌减少。对不同腺体的抑制作用强度不同，对唾液腺（M₃受体亚型）和汗腺的作用最为明显。2.眼科应用：阿托品阻断眼部所有M胆碱受体，表现为扩瞳、眼压升高（A错）和调节麻痹。3.解除平滑肌痉挛：适用于各种内脏绞痛，对胃肠绞痛、膀胱刺激症状如尿频、尿急等疗效较好。也可用于儿童遗尿症，可增加膀胱容量，减少小便次数。但对胆绞痛或肾绞痛疗效较差，常需与阿片类镇痛药合用。4.缓慢型心律失常（D错）：阿托品能解除迷走神经对心脏的抑制作用，可用于治疗迷走神经过度兴奋所致的窦性心动过缓、窦房阻滞、房室传导阻滞等缓慢型心律失常。5.抗休克：对暴发型流行性脑脊髓膜炎、中毒性菌痢、中毒性肺炎等所致的感染性休克患者（E错），可用大剂量阿托品治疗，能解除血管痉挛，舒张外周血管，改善微循环。但对休克伴有高热或心率过快者不宜使用。6.解救有机磷酸酯类中毒。